病例对照研究的对照组
A. 可来源于医院
B. 可来源于一般人群
C. 两者均是
D. 两者均否

正确答案：C。两者均是

解析：本题考查病例对照研究的对照组的来源。在病例对照研究中对照的来源主要包括：①同一个或多个医疗机构中诊断的其他疾病的病人；②社区人群或团体人群中非该病病例或健康人；③病例的邻居或同一住宅区内的健康人或非该病病例；④病例的配偶、同胞、亲戚、同学或同事等。题中两者均是（C对ABD错）病例对照研究中对照组的来源。